可持续发展目标再次将（）放在了全球发展的重要位置
A. 经济发展
B. 健康卫生
C. 文化建设
D. 素质建设
E. 农业建设

正确答案：B。健康卫生